下列检查项目中，属于“一般杂质”检查的有
A. 有关物质
B. 光学异构体
C. 氯化物
D. 重金属
E. 砷盐

正确答案：C、D、E。氯化物；重金属；砷盐

解析：本题考查一般杂质检查。一般杂质是指在自然界中分布广泛，在多种药物的生产过程中容易引入的杂质，如氯化物（C对）、干燥失重、炽灼残渣、重金属（D对）、砷盐（E对）等。